每次行经，小腹冷痛，遇暖则疼痛减缓，证属
A. 寒凝
B. 气血亏虚
C. 气滞
D. 瘀血
E. 痰湿

正确答案：A。寒凝

解析：本题考查的是行经腹痛的临床意义。每次行经，小腹冷痛，遇暖则疼痛减缓，证属寒凝（A对）。行经腹痛的临床意义：行经时腰腹作痛，甚至剧痛不能忍受，并随月经周期持续发作，称为痛经。经前或经期小腹胀痛者，多属气滞血瘀（CD错）；小腹冷痛，遇暖则缓者，多属寒凝；行经或经后小腹隐痛、腰酸痛者，乃气血亏虚（B错），胞脉失养所致。痰湿（E错）阻滞可致月经过少。